天疱疮治疗的首选药物是
A. 抗生素
B. 糖皮质激素
C. 免疫增强剂
D. 维生素
E. 以中药治疗为主

正确答案：B。糖皮质激素

解析：糖皮质激素为本病的首选药物。激素治疗天疱疮主要是抑制天疱疮抗体的产生。首选药物是泼尼松，轻、中、重患者首剂量每天应分别为40mg、60mg、80mg。如果用药3～7天内仍不断有新疱出现，可在首剂量的基础上再增加50%直至病情得到控制。病损消退2周后开始缓慢有规律地减量，起初2～4周减一次，以后4～8周减1次，每次减量10%～15%，直至维持量。掌握“天疱疮”知识点。